患儿，女，2岁，形体明显消瘦，肚腹鼓胀，面色萎黄无华，毛发稀疏失润如穗结，精神不振，纳差，大便溏。查体：体重9kg，心、肺（-），腹壁皮下脂肪0.35cm，舌淡苔少。诊断为营养不良，其程度是
A. 疳气Ⅰ度
B. 疳气Ⅱ度
C. 疳积Ⅱ度
D. 疳积Ⅲ度
E. 干疳Ⅲ度

正确答案：C。疳积Ⅱ度

解析：本病已明确诊断为营养不良，即“蛋白质-能量营养不良”病，此属于中医“疳证”范畴。根据病情轻重、病程长短及病机虚实，疳证可具体分为疳气、疳积和干疳：其中，疳气以形体略瘦，面色少华，食欲不振，性情急躁为主要临床特征（AB错）；疳积以形体消痩，肚腹胀大，面黄发疏为主要临床特征；干疳以形体极度消痩，精神萎靡，杳不思食为主要临床特征（E错）。同时，依据体重的降低程度可以判断病情程度：体重低于同年龄、同性别参照人群值的均数减2个标准差，为轻度；体重低于同年龄、同性别参照人群值的均数减2～3个标准差，为中度；体重低于同年龄、同性别参照人群值的均数减3个标准差，为重度。根据该患儿以形体明显消瘦，肚腹鼓胀为临床主症，可辨为"疳积"；2岁女童的平均体重为11.92kg，标准差约为1.2，该患儿体重为9kg，比同年龄、同性别参照人群值的体重均数低了2.92kg，即低于同年龄、同性别参照人群值的均数减2～3个标准差，故为中度。因此，其营养不良的程度是疳积Ⅱ度（C对）。